关节盘穿孔、破裂表现为
A. 开口初、闭口末清脆单声弹响
B. 开口末、闭口初清脆单声弹响
C. 最大开口位关节弹响
D. 连续摩擦音或多声破碎音
E. 一般无弹响

正确答案：D。连续摩擦音或多声破碎音

解析：破碎音为开口运动中有“咔叭、咔叭”的破碎声音，关节盘穿孔、破裂或移位时可出现这类杂音；摩擦音为在开口运动中有连续的似揉玻璃纸样的摩擦音，多见于骨关节病。掌握“颞下颌关节紊乱”知识点。